原植物属于菊科的药材有
A. 金钱草
B. 青蒿
C. 茵陈
D. 蒲公英
E. 穿心莲

正确答案：B、C、D。青蒿；茵陈；蒲公英

解析：本题考查的是全草类中药的科属。原植物属于菊科的药材有青蒿（B对）、茵陈（C对）、蒲公英（D对）。青蒿：【来源】为菊科植物黄花蒿的干燥地上部分。茵陈：【来源】为菊科植物滨蒿或茵陈蒿的干燥地上部分。蒲公英：【来源】为菊科植物蒲公英、碱地蒲公英或同属数种植物的干燥全草。金钱草（A错）：【来源】为报春花科植物过路黄的干燥全草。穿心莲（E错）：【来源】为爵床科植物穿心莲的干燥地上部分。